水溶性维生素特点描述错误的是
A. 可在体内大量贮存，引起中毒
B. 摄入过多时可经尿液排出体外
C. 易溶于水，不溶于脂肪
D. 主要以辅酶的形式参与机体代谢
E. 摄入少时，很快出现缺乏症状

正确答案：A。可在体内大量贮存，引起中毒